对高血压合并糖尿病患者，血压控制在
A. 130/80mmHg
B. 130/85mmHg
C. 135/85mmHg
D. 140/90mmHg
E. 150/90mmHg

正确答案：A。130/80mmHg

解析：一般主张血压控制目标值应＜140/90mmHg（D错）。高血压合并糖尿病、慢性肾脏病、心力衰竭或病情稳定的冠心病，血压控制目标值＜130/80mmHg（A对BCE错）。对于老年收缩期高血压患者，收缩压控制于150mmHg以下，如果能耐受可降至140mmHg以下。